某校住校生郑某感到不适，几天后确诊为病毒性肝炎。校保健室初步诊治，便安排其去市医院住院治疗，并未引起注意。过了几天后，又有郑某的同学、班主任教师、军训的军官相继发病。保健室的负责人及班主任老师为此受到学校的严厉批评。对于郑某的发病必须按照卫健委规定的时限向当地卫生防疫部门报告的是
A. 郑某
B. 校保健室
C. 班主任老师
D. 军训教官
E. 学校

正确答案：B。校保健室